选择环境流行病学健康效应测量的对象时，主要应考虑
A. 儿童
B. 妇女
C. 老年人
D. 高危人群
E. 低危人群

正确答案：D。高危人群

解析：本题考查环境流行病学健康效应测量的对象。选择环境流行病学健康效应测量的对象时，主要应考虑高危人群（D对ABCE错）。如某甲基汞污染区居民健康危害的调查，可选择食用含甲基汞的鱼数量多或头发甲基汞含量高的居民作为调查对象。